对脑血管扩张作用最强的药物是
A. 硝苯地平
B. 尼莫地平
C. 非洛地平
D. 尼索地平
E. 尼群地平

正确答案：B。尼莫地平

解析：尼莫地平等扩张外周血管作用较强，用于控制严重的高血压，长期用药后，全身外周阻力可明显下降。此外，尼莫地平舒张脑血管作用较强，能增加脑血流量。掌握“钙通道阻滞药分类及代表药物”知识点。